关于药物信息（DI）的叙述，正确的是
A. 药学研究和开发的信息
B. 通过载体传递的药学知识
C. 与临床药学和药疗保健有关的信息
D. 药物市场的价格信息
E. 药物专利信息

正确答案：C。与临床药学和药疗保健有关的信息

解析：本题考查的是药物信息。关于药物信息（DI）的叙述，正确的是与临床药学和药疗保健有关的信息（C对）。在使用领域中一些与临床药学相关的各种药学信息称为药物信息，是临床药学和药疗保健的一项重要工作和活动。